医疗机构逾期不校验《医疗机构执业许可证》仍从事诊疗活动的，拒不校验的
A. 1千元以下罚款
B. 3千元以下罚款
C. 5千元以下罚款
D. 8千元以下罚款
E. 吊销《医疗机构执业许可证》

正确答案：E。吊销《医疗机构执业许可证》

解析：医疗机构逾期不校验《医疗机构执业许可证》仍从事诊疗活动的，由县级以上人民政府卫生行政部门责令其限期补办校验手续；拒不校验的，吊销其《医疗机构执业许可证》。掌握“医疗机构登记和校验及法律责任”知识点。